女性，血压150/60mmHg，有感染病史，心脏听诊收缩期吹风样和舒张期隆隆样杂音，双下肢无水肿，诊断为
A. 动脉导管未闭
B. 主动脉瓣关闭不全
C. 主动脉瓣狭窄
D. 二尖瓣关闭不全合并狭窄
E. 肺动脉瓣狭窄

正确答案：D。二尖瓣关闭不全合并狭窄

解析：女性，血压150/60mmHg，有感染病史（常累及二尖瓣），心脏听诊收缩期吹风样和舒张期隆隆样杂音，根据感染病史及心脏杂音，最可能的诊断为二尖瓣关闭不全合并狭窄（D对）。动脉导管未闭属于先心病（A错）。主动脉关闭不全（B错）杂音为主动脉瓣区舒张期杂音，为一高调递减型叹气样杂音。主动脉瓣狭窄杂音（C错）为胸骨左缘第3肋间听到主动收缩期喷射性杂音。肺动脉瓣狭窄（E错）可在肺动脉瓣听诊区闻及收缩期喷射样杂音。